一般来说，除了一些耐渗透压微生物，微生物（细菌、真菌、酵母）生长所需的水分活度Aw需要
A. ＞0.7
B. ＞0.8
C. ＜0.8
D. ＜0.7
E. ＜0.6

正确答案：B。＞0.8

解析：本题考查微生物（细菌、真菌、酵母）生长所需的水分活度Aw。一般来说，细菌生长所需的Aw＞0.9，酵母菌为＞0.87，真菌为＞0.8，因此，除了一些耐渗透压微生物，微生物（细菌、真菌、酵母）生长所需的水分活度Aw需要＞0.8（B对ACDE错）。